发于小腿足部的丹毒是
A. 抱头火丹
B. 内发丹毒
C. 流火
D. 流注
E. 赤游丹毒

正确答案：C。流火

解析：发于头面部者，称抱头火丹（A错）。生于躯干部者，称内发丹毒（B错）。发于小腿足部者，称流火（C对）。新生儿多生于臀部，称赤游丹毒（E错）。